对各种疟原虫的红细胞内期裂殖体均有较强的杀灭作用，但不能用于病因预防的药物是
A. 伯氨喹
B. 青蒿素
C. 乙胺嘧啶
D. 甲硝唑
E. 氯喹

正确答案：E。氯喹

解析：氯喹对各种疟原虫的红细胞内期裂殖体均有较强的杀灭作用，但是不能用于病因预防以及控制远期复发和传播。掌握“氯喹、青蒿素、伯氨喹及乙胺嘧啶”知识点。